研究者对某铜矿厂全体男职工共150人开展一项前列腺癌筛查研究，筛查出阳性为100人，其中有73人确诊为前列腺癌：阴性为50人，确诊没有前列腺癌的为43人。则约登指数为
A. 0.43
B. 0.52
C. 0.76
D. 0.88
E. 0.97

正确答案：B。0.52

解析：约登指数又称正确指数，是灵敏度和特异度之和减1。用a代表真阳性，b代表假阳性，c代表假阴性，d代表真阴性，灵敏度=a/a+c=73/73+7=0.91，特异度=d/b+d=43/27+43=0.61，约登指数=0.91+0.61-1=0.52（B对）。